下列关于狂犬病病毒的叙述中，正确的描述是
A. 病兽发病前10天唾液开始排毒
B. 抵抗力强，不被碘、乙醇、肥皂水等灭活
C. 固定毒株接种动物发病所需潜伏期长
D. 可用灭活疫苗预防
E. 可在感染细胞质内形成嗜碱性包涵体

正确答案：D。可用灭活疫苗预防

解析：由于狂犬病的潜伏期较长，如及早应急接种狂犬病疫苗，于咬伤后第0、3、7、14、30日，各肌内注射1ml，可能预防发病。掌握“狂犬病、人乳头瘤病毒”知识点。